小儿囟门迟闭，多属
A. 温病火邪上攻，脑髓有病
B. 吐泻伤津，或气血不足
C. 肾气不足，发育不良
D. 肾阴不足，虚火上炎
E. 以上都不是

正确答案：C。肾气不足，发育不良

解析：解颅，即囟门迟闭，骨缝不合，此为肾气不足，发育不良的表现，多见于佝偻病患儿（C对）。囟填，即囟门突起，多属实证，多因温病火邪上攻；或颅内水液停聚；或脑髓有病所致（A错）。囟陷，即囟门凹陷，多属虚证，多因吐泻伤津，气血不足（B错）和先天肾精亏虚，脑髓失充所致。肾阴不足，虚火上炎不是囟门迟闭的原因（D错）。